对一种疾病的病因的某种可疑因素进行病因学研究时，可采用观察性方法或实验性方法，这两种方法的基本区别是，在实验性调查研究中
A. 实验组与对照组的样本大小相等
B. 这种研究是前瞻性的
C. 实验组与对照组总是一致的
D. 人为给予的干预
E. 使用对照的方法

正确答案：D。人为给予的干预

解析：本题考查实验流行病学的特点。实验流行病学不同于描述性和分析性流行病学，后者在研究实施中只是描述或分析人群中的某些现象，从中找出规律性的结论，属于观察法。实验流行病学属于实验法，即有人为给予的干预（D对ABCE错）措施，并强调随机分配。